某铸造厂安排其就业前工人进行全面的健康检查，以下说法不正确的是
A. 属于就业前体检
B. 属于职工健康监护内容
C. 目的是发现职业禁忌症
D. 属于一级预防
E. 属于二级预防

正确答案：E。属于二级预防

解析：本题考查第一级预防和第二级预防的概念。第一级预防（D对）又称病因预防，是从根本上消除或控制职业性有害因素对人的作用和损害。可依据《职业健康监护（B对）技术规范》（GBZ188-2007）对就业禁忌证进行检查，凡有职业禁忌证者，禁止从事相关的工作，入职前的健康体检，属于就业前体检（A对），正是筛查职业禁忌证（C对）的关键步骤，因此入职前体检属于第一级预防。第二级预防（E错，为本题正确答案）的主要手段是定期进行职业性有害因素的监测和对接触者的定期体格检查，以早期发现病损和诊断疾病，特别是早期健康损害的发现，及时预防、处理，与入职之前的健康检查不符。